女性输尿管下部前方有
A. 膀胱底
B. 输卵管
C. 子宫
D. 子宫动脉与之相交
E. 髂内动脉

正确答案：D。子宫动脉与之相交

解析：女性输尿管盆部经子宫颈外侧时，前方有子宫动脉与之相交（D对）。